患者，女性，78岁，口角糜烂两个月。查：双侧口角区皮肤黏膜增厚呈灰白色，伴细小裂纹。全口义齿重度磨耗。此患者应属于哪一类口角炎
A. 营养不良性口角炎
B. 感染性口角炎
C. 接触性口角炎
D. 创伤性口角炎
E. 以上均不是

正确答案：B。感染性口角炎

解析：本题考查感染性口角炎的特点。患者女，78岁（体质较弱），口角糜烂两个月。查：双侧口角区皮肤黏膜增厚呈灰白色，伴细小裂纹。全口义齿重度磨耗（颌间垂直距离缩短）。上述症状，此患者应属于感染性口角炎（B对）。感染性口角炎急性期呈现口角区充血，红肿、有血性或脓性分泌物渗出，层层叠起呈污秽状的血痂或脓痂，疼痛明显，慢性期口角区皮肤黏膜增厚呈灰白色，伴细小横纹或放射状裂纹，唇红干裂，但疼痛不明显，此外，尚有猩红热、疱疹、梅毒、艾滋病等原发病的其他相应症状。营养不良性口角炎（A错）由营养不良、维生素缺乏引起，可单侧或双侧同时发病，表现为口角处水平状浅表皲裂，常呈底在外，尖在内的楔形损害，稍大的皲裂区可有渗出和渗血，结有黄色痂皮或血痂，口角区皮肤受长期溢出的唾液浸渍而发白，伴有糜烂。接触性口角炎（C错）多见于具有过敏体质的病人，接触了具有过敏原的物质以后导致的口角炎的发作，出现口角区的肿胀、糜烂、红肿、渗出、结痂，在去除致敏性物质几天以后基本上可以消除。创伤性口角炎（D错）由口角区医源性创伤、严重的物理刺激或某些不良习惯引起，常为单侧性口角区长短不一的新鲜创口，裂口常有渗血、血痂，陈旧创口则有痂皮水肿、糜烂，外伤引起者可伴局部组织水肿、皮下淤血。